治疗急性胰腺炎，禁忌应用
A. 抗胆碱能药物
B. 钙剂
C. 胃肠减压
D. 吗啡止痛
E. 补充血容量

正确答案：D。吗啡止痛

解析：治疗急性胰腺炎，禁忌应用吗啡止痛。吗啡主要的适应症是有极强的镇痛作用，多用于手术，烧伤，创伤等严重疼痛发生的疾病，也可用于急性心肌梗死的镇痛，还可以发挥镇咳，止泻等药理作用（D对）。抗胆碱能药对治疗急性胰腺炎肯定有其指征，可以给到耐受量。其它的处理方法在于降低酸度，从而抑制分泌素的释放（A错）。急性胰腺炎在治疗和恢复阶段都需要补充钙（B错）。胃肠减压其目的是通过留置鼻胃管，将胃液引流至体外，从而避免胃液对于胰腺的刺激，同时减轻胃潴留引起的腹胀（C错）。由于胰腺坏死，刺激机体炎症介质产生级联瀑布反应，渗出增加，容易引起低血容量性休克，需补充血容量（E错）。